VK含量测定方法为
A. 碘量法
B. 非水溶液滴定法
C. 高效液相色谱法
D. 毛细管电泳法
E. 气相色谱法

正确答案：C。高效液相色谱法

解析：本题考查维生素K的含量测定。维生素K₁的含量测定采用高效液相色谱法（C对）。气相色谱法（E错）用于维生素E及其制剂的含量测定。